患者，男，35岁。进食时左侧下颌下腺区肿胀、疼痛，停止进食数小时后，疼痛亦随之消退。检查见左侧导管口黏膜红肿，导管呈条索状，挤压腺体可见少许脓性分泌物自导管口溢出。应与本病相鉴别的疾病是
A. 舌下腺肿瘤
B. 下颌下腺肿瘤
C. 慢性硬化性下颌下腺炎
D. 下颌下淋巴结炎
E. 以上均是

正确答案：E。以上均是

解析：典型的涎石病诊断不难，有时需和下列疾病鉴别：①舌下腺肿瘤；②下颌下腺肿瘤；③慢性硬化性下颌下腺炎；④下颌下淋巴结炎；⑤下颌下间隙感染。掌握“涎石病及下颌下腺炎”知识点。